非处方药的特点
A. 可长久使用，老小皆宜
B. 缓解轻度不适，治疗轻微病证
C. 保管方便，不会变质
D. 价格便宜，购买方便
E. 没有耐药性，刺激性

正确答案：B。缓解轻度不适，治疗轻微病证

解析：本题考查的是非处方药的特点。非处方药的特点缓解轻度不适，治疗轻微病证（B对）。非处方药主要有以下特点：①安全性高，正常使用时无严重不良反应或其他严重的有害相互作用。②疗效确切，适应证或功能主治明确，药品临床作用确切、效果好、不需要经常调整剂量。③质量稳定，在正常条件下储存时质量稳定。④使用方便，消费者可以根据说明书使用，不需要医护人员的治疗监护，以口服和外用为主。